引起出血性结肠炎和溶血性尿毒综合征的病原菌是
A. 肠产毒型大肠埃希菌（ETEC）
B. 肠出血型大肠埃希菌（EHEC）
C. 肠致病性大肠埃希菌（EPEC）
D. 肠侵袭性大肠埃希菌（EIEC）
E. 肠集聚型大肠埃希菌（EAEC）

正确答案：B。肠出血型大肠埃希菌（EHEC）

解析：肠出血型大肠埃希菌（EHEC）引起以反复出血性腹泻和严重腹痛为特征的出血性结肠炎，表现为大量血样便腹泻。在5岁以下的患儿中，易并发溶血性尿毒综合征（HUS），表现为溶血性贫血，继而发展为急性肾衰竭。掌握“肠道杆菌共性及埃希氏菌属”知识点。